结核分枝杆菌引起机体的免疫是
A. 局部免疫
B. 感染免疫
C. 体液免疫
D. 抗毒素免疫
E. 抗菌免疫

正确答案：B。感染免疫